地震现场，一工人左腰及下肢被倒塌之砖墙压住，震后6小时救出，4小时后送抵医院。诉口渴，尿少，呈暗红色。检查：脉搏120次/min，血压95/70mmHg，左下肢明显肿胀，皮肤有散在淤血斑及水疱，足背动脉搏动较健侧弱，趾端凉，无骨折征。首先应采取的处理是
A. 止痛
B. 左下肢固定
C. 镇静
D. 胸腔闭式引流
E. 吸氧

正确答案：B。左下肢固定

解析：该患者左腰部及下肢（为肌肉丰富的部位）长时间受压，解除挤压后出现尿少，色暗红（提示为血红蛋白尿，考虑该患者有肾功能受损），下肢明显肿胀，足背动脉搏动减弱（提示血栓形成或肢体远端张力过高），应诊断为挤压伤综合征。挤压伤综合征的治疗原则：①紧急处理：解除外力压迫，缩短受压时间；②妥善固定伤肢：立即用夹板或代用品固定伤肢于适当位置，以避免搬运过程中加重损伤。不宜抬高、按摩和热敷伤肢，以减少毒素的吸收；③抗休克：首选等渗盐水或平衡盐液扩容，改善循环；④碱化尿液：肌（血）红蛋白在碱性尿中溶解度大，可予5%碳酸氢钠100～200ml静滴，促使血红蛋白结晶溶解，防止肾小管堵塞。综合以上治疗措施，该患者在补液纠酸的同时应首先采取的处理是左下肢固定（B对）。止痛（A错）、镇静（C错）、吸氧（E错）为一般性治疗措施。本例无胸部外伤，无需行胸腔闭式引流（D错）。